分级诊疗正确的是
A. 非急症患者不可急诊就诊
B. 自下向上进行转诊
C. 鼓励非急症患者到基层医院首诊
D. 各级医院报销比例相等
E. 患者可根据自己意愿就诊

正确答案：C。鼓励非急症患者到基层医院首诊

解析：（P383）针对分级诊疗，基层首诊和双向转诊是其主要内容，基层首诊指坚持群众自愿、政策引导，鼓励并逐步规范常见病、多发病患者首先到基层医疗卫生机构就诊（C对AE错），对于超出基层医疗卫生机构功能定位和服务能力的疾病，由基层医疗卫生机构为患者提供转诊服务（B错）。各级医院报销比例按照当地医保政策进行报销（D错）。